女，21岁。左胫骨下段横行骨折。经手法复位石膏固定后复查X线片，符合功能复位的是
A. 断端旋转5°
B. 断端重叠2cm
C. 骨折向外侧成角5°
D. 断端分离1.2cm
E. 骨折向前方成角5°

正确答案：E。骨折向前方成角5°

解析：此题按照九版教材没有正确答案，因为九版教材表示成角移位必须完全复位。按照八版教材功能复位指经复位后，两骨折端虽未恢复至正常的解剖关系，但在骨折愈合后对肢体功能无明显影响。功能复位要求骨折部位的旋转（A错）和分离（D错）移位必须完全矫正；成人下肢骨折断端重叠不超过1cm（B错）；下肢骨折轻微的向前向后成角，与关节活动方向一致，日后可自行矫正，而向侧方的成角移位，与关节活动方向垂直，必须完全复位。胫骨下段骨折向前方成角5°（E对），与踝关节活动方向一致，符合功能复位标准。骨折向外侧成角5°（C错）与踝关节活动方向垂直，必须完全复位。